对地高辛引起的窦性心动过缓和轻度房室传导阻滞最好选用
A. 阿托品
B. 异丙肾上腺素
C. 苯妥英钠
D. 肾上腺素
E. 氯化钾

正确答案：A。阿托品

解析：地高辛可抑制窦房结、降低其自律性而发生窦性心动过缓，有时可使心率降至60次/分以下，为停药指征。消除此中毒症状的方法不宜补K+，可用M受体阻断剂阿托品治疗。掌握“强心苷、ACE抑制剂”知识点。